硅酸盐肺中危害最大的是
A. 滑石肺尘埃沉着病
B. 陶土肺尘埃沉着病
C. 云母肺尘埃沉着病
D. 石棉肺
E. 水泥肺尘埃沉着病

正确答案：D。石棉肺